山药生产于
A. 河南
B. 云南
C. 浙江
D. 四川
E. 新疆

正确答案：A。河南

解析：本题考查的是山药的产地。山药生产于河南（A对）。山药【产地】主产于河南省的温县、武陟、博爱、沁阳等地（旧怀庆府），湖南、江西、广东、广西等地亦产。均为栽培品。木香【产地】主产于云南（B错）。四川、西藏亦产。为栽培品。玄参【产地】主产于浙江（C错）省，四川、湖北、江苏等省亦产。多为栽培品。川牛膝【产地】主产于以四川（D错）天全县、宝兴县所产质量最佳。云南、贵州、西藏、湖北、湖南等地亦有栽培。紫草【来源】为紫草科植物新疆紫草或内蒙紫草的干燥根。药材分别习称“软紫草”“内蒙紫草”。【产地】新疆紫草主产于新疆（E错）；内蒙紫草主产于内蒙古、甘肃等省区。